以下不是肝门静脉属支的是
A. 肠系膜上静脉
B. 肝静脉
C. 胃左静脉
D. 脾静脉
E. 无

正确答案：B。肝静脉

解析：肠系膜上静脉（A对）、胃左静脉（C对）、脾静脉（D对）均为肝门静脉的属支。肝静脉（B错，为本题正确答案）为下腔静脉的属支。